构成心右缘的是
A. 右心房和右心室
B. 右心室
C. 右心房
D. 右心房和上腔静脉
E. 右心室和下腔静脉

正确答案：C。右心房

解析：右心房（C对）构成心右缘。右心室和心尖构成心下缘。左心室和左心耳构成心左缘。